《金匮要略》中苓桂术甘汤主治
A. 咳逆倚息短气不得卧的支饮
B. 心下坚大如盘的水饮所作
C. 身体疼重不汗出的溢饮
D. 自利利反快脉伏的留饮
E. 胸胁支满目眩的心下痰饮

正确答案：E。胸胁支满目眩的心下痰饮

解析：心下，即胃之所在，故此当属狭义痰饮证。饮停中州，阻碍气机，浊阴不降，弥漫于胸胁则支撑胀满；清阳不升，浊阴上蒙清窍则头昏目眩。病机属脾胃阳虚，痰饮中阻（E对）。治用苓桂术甘汤温阳化饮，健脾利水。方中茯苓淡渗利水。化饮降浊。为治饮病之要药，桂枝辛温通阳，振奋阳气以消饮邪，两药合用，可温阳化饮；白术健脾燥湿，甘草和中益气，两药相伍，补土制水。本方是温阳化饮的主要方剂，亦是“温药和之”的具体运用。